从代谢产物中发现的H₁受体拮抗剂药物有
A. 马来酸氯苯那敏
B. 阿司咪唑
C. 盐酸赛庚啶
D. 地氯雷他定
E. 非索非那定

正确答案：D、E。地氯雷他定；非索非那定

解析：本题考查H₁受体拮抗剂药物类型。地氯雷他定（D对）为氯雷他定主要的活性代谢产物，具有选择性的抗外周H₁受体作用。非索非那定（E对）为特非那定的活性代谢物，具有选择性外周H₁受体拮抗剂作用。